根尖部的炎性肉芽增生，可见泡沫细胞、含铁血黄素和胆固醇结晶沉着，是以上哪种的病理表现
A. 慢性根尖周肉芽肿
B. 致密性骨炎
C. 慢性根尖周脓肿
D. 急性浆液性根尖周炎
E. 急性牙槽脓肿

正确答案：A。慢性根尖周肉芽肿

解析：本题考查急慢性根尖周炎。慢性根尖周肉芽肿（A对）中的周围的纤维组织增生，还可见吞噬脂质的泡沫细胞呈灶性分布，部分病例可见含铁血黄素和胆固醇结晶沉着（梭形裂隙）。